高血压患者遵从医嘱服药的强化因素是
A. 经济条件足以支付较高的医药费
B. 在按医嘱服药后血压得到有效控制
C. 能方便地就医、取药
D. 对治疗高血压采取积极态度
E. 知晓服药能有效控制血压

正确答案：B。在按医嘱服药后血压得到有效控制

解析：在按医嘱服药后血压得到有效控制（B对），是患者经过治疗后所得到的生理效应，属于强化因素。对治疗高血压采取积极态度（D错）属于倾向因素。经济条件足以支付较高的医药费（A错）、能方便地就医、取药（C错）、知晓服药能有效控制血压促成因素（E错）应属于促成因素。